老年人心梗冠脉支架术，当时造影满意，术后1月出现反复低热，伴心包摩擦音，最可能的诊断
A. 心力衰竭
B. 胸膜炎
C. 心脏破裂
D. 心肌梗死后综合征
E. 结核性心包炎

正确答案：D。心肌梗死后综合征

解析：患者老年人，既往行心梗冠脉支架术，术后1月出现反复低热，伴心包摩擦音（心肌梗死后综合征的表现），故结合患者的年龄，既往史和表现，提示为心肌梗死后综合征（D对BE错）。心脏破裂少见，常在起病1周内出现，多为心室游离壁破裂，造成心包积血引起急性心脏压塞而猝死。偶为心室间隔破裂造成穿孔，在胸骨左缘第3~4 肋间出现响亮的收缩期杂音，常伴有震颤，可引起心力衰竭和休克而在数日内死亡，心脏破裂也可为亚急性，病人能存活数个月（AC错）。